对医德良心的不正确理解是
A. 医德良心是医务人员对病人履行义务的道德责任感
B. 医德良心是医务人员对病人履行义务的自我评估能力
C. 医德良心是医务人员医德情感的深化
D. 医德良心是医务人员天生的对病人的行善之心
E. 医德良心是医务人员在医疗活动中养成的自律机制

正确答案：D。医德良心是医务人员天生的对病人的行善之心